某患者出现颈静脉怒张、肝肿大和双下肢水肿，最可能的心血管疾病是
A. 左心衰
B. 右心衰
C. 肺水肿
D. 高血压
E. 中心静脉压降低

正确答案：B。右心衰